LDL是指
A. 运送内源性TG
B. 运送内源性Ch
C. 运送外源性TG
D. 蛋白质含量最高
E. 与冠状动脉粥样硬化的发生率呈负相关

正确答案：B。运送内源性Ch

解析：低密度脂蛋白：血浆脂蛋白的一种，是血液中胆固醇的主要载体。掌握“甘油磷脂、胆固醇和血脂蛋白代谢”知识点。